温病后期，夜热早凉，热退无汗，舌红少苔，脉细数，治宜用
A. 清营汤
B. 清骨散
C. 竹叶石膏汤
D. 青蒿鳖甲汤
E. 秦艽鳖甲散

正确答案：D。青蒿鳖甲汤

解析：舌红少苔，脉象细数，提示阴伤，故无以作汗而无汗；夜热早凉，提示邪热伏于阴分——卫阳之气，日行于表，而夜入于里，入夜则阳气入阴，与阴分之伏热，两阳相加，而身热；平旦卫气行于表，阳出于阴，则热退身凉。故此为温病后期，余热深入伏于阴分，阴液已伤，当予以养阴、透热，宜选青蒿鳖甲汤（D对）——青蒿苦辛而寒，其气芳香，故清中有透散之力，能清热透络，引邪外出，鳖甲咸寒，可滋阴，直入阴分，可退阴分之热，二者共为君药，以内清外透阴分伏热，并滋阴液；同时，配生地、知母以滋阴降火，丹皮辛苦凉，泄血中伏火。清营汤功用为清营解毒，透热养阴，主治热入营分证（A错）。清骨散功用为清虚热，退骨蒸，主治肝肾阴虚，虚火内扰证（B错）。竹叶石膏汤功用为清热生津，益气和胃，主治伤寒、温病、暑病余热未清，气津两伤证（C错）。秦艽鳖甲散功用为滋阴养血，清热除蒸，主治阴亏血虚，风邪传里化热之风劳病（E错）。